根据《麻醉药品和精神药品管理条例》，定点批发企业未依照规定储存麻醉药品和精神药品的
A. 由药品监督管理部门取消其定点批发资格，并依照药品管理法的有关规定处罚
B. 由药品监督管理部门责令改正，给予警告，没收违法交易的药品，并处罚款
C. 由设区的市级人民政府卫生主管部门责令限期改正，给予警告
D. 由县级以上人民政府卫生主管部门给予警告，暂停其执业活动
E. 由药品监督管理部门责令限期改正，给予警告

正确答案：E。由药品监督管理部门责令限期改正，给予警告

解析：本题考查违反麻醉药品和精神药品管理规定的法律责任。根据《麻醉药品和精神药品管理条例》，定点批发企业未依照规定储存麻醉药品和精神药品的由药品监督管理部门责令限期改正，给予警告（E对）。经营企业违反麻醉药品和精神药品管理规定的法律责任：1.定点批发企业：根据《麻醉药品和精神药品管理条例》第六十八条规定，定点批发企业违反规定销售麻醉药品和精神药品，或者违反规定经营麻醉药品原料药和第一类精神药品原料药的，由药品监督管理部门责令限期改正，给予警告，并没收违法所得和违法销售的药品；逾期不改正的，责令停业，并处违法销售药品货值金额两倍以上五倍以下的罚款；情节严重的，取消其定点批发资格。根据《麻醉药品和精神药品管理条例》第六十九条规定，定点批发企业违反麻醉药品和精神药品的管理规定，有下列情形之一的，由药品监督管理部门责令限期改正，给予警告；逾期不改正的，责令停业，并处两万元以上五万元以下的罚款；情节严重的，取消其定点批发资格：①未依照规定购进麻醉药品和第一类精神药品的；②未保证供药责任区域内的麻醉药品和第一类精神药品的供应的；③未对医疗机构履行送货义务的；④未依照规定报告麻醉药品和精神药品的进货、销售、库存数量以及流向的；⑤未依照规定储存麻醉药品和精神药品，或者未依照规定建立、保存专用账册的；⑥未依照规定销毁麻醉药品和精神药品的；⑦区域性批发企业之间违反规定调剂麻醉药品和第一类精神药品，或者因特殊情况调剂麻醉药品和第一类精神药品后未依照规定备案的。2.第二类精神药品零售企业：根据《麻醉药品和精神药品管理条例》第70条的规定，第二类精神药品零售企业违反规定储存、销售或者销毁第二类精神药品的，由药品监督管理部门责令限期改正，给予警告，并没收违法所得和违法销售的药品；逾期不改正的，责令停业，并处五千元以上两万元以下的罚款；情节严重的，取消其第二类精神药品零售资格。